对于甲状腺破坏所导致的甲状腺毒症，下列实验室检查正确的是
A. 甲状腺肿大
B. 血T3、T4↑，甲状腺摄131I（碘131）率明显↑
C. 血T3、T4↑，甲状腺摄131I（碘131）率明显↓
D. TSH明显↓
E. TgAb与TPOAb明显↑

正确答案：C。血T3、T4↑，甲状腺摄131I（碘131）率明显↓

解析：甲状腺毒症虽然血清甲状腺激素水平增高，但是131 I 摄取率减低，因为甲状腺细胞被炎症损伤，减少摄碘的能力（C对)。